患者，男，28岁。高血压病史半年，近日头痛加重，恶心，呕吐，心悸，气短。检查：血压190/135mmHg，眼底视网膜出血，心电图示左室肥厚，心肌劳损。其诊断是
A. 高血压脑病
B. 缓进型高血压病
C. 脑血管痉挛
D. 急进型高血压病
E. 急性心力衰竭

正确答案：D。急进型高血压病

解析：本例患者为青年男性，有高血压病史半年，近日病情急剧恶化，出现头痛加重、恶心、呕吐等症状，体格检查可见血压为190/135mmHg，属于3级高血压，同时伴有眼底微血管病变和心肌病变，其诊断首先考虑为急进型高血压病（D对）。高血压脑病（A错）好发于豆纹动脉和基底动脉，容易出现出血性脑卒中，临床主要表现为头痛、视神经乳头水肿等。缓进性高血压病（B错）起病隐匿，病情发展缓慢，病程较长，可达数十年。脑血管痉挛（C错）患者的主要临床表现为头晕和头痛，一般不会有眼底病变和心肌损害等改变。急性心力衰竭（E错）患者的主要临床表现为呼吸困难，且活动后加剧，一般不会有眼底病变等改变。